胺碘酮
A. 延长APD，阻滞Na⁺内流
B. 缩短APD，阻滞Na⁺内流
C. 延长ERP，促进K⁺外流
D. 缩短APD，阻断β受体
E. 缩短ERP，阻断α受体

正确答案：A。延长APD，阻滞Na⁺内流